关于Zac说法正确的是
A. Zac=Limac/LD₅₀
B. Zac越大，表明化学物质引起急性死亡的危险性越大
C. Zac值是一个相对稳定的指标
D. Zac是急性毒性常用参数之一
E. 以上说法均正确

正确答案：D。Zac是急性毒性常用参数之一